促进排卵药物不包括
A. 尿促性素
B. 氯米芬
C. 促性腺激素释放激素
D. 卵泡刺激素
E. 孕激素

正确答案：E。孕激素

解析：促排卵药物包括尿促性素（hMG）（A对）、氯米芬（B对）、促性腺激素释放激素（C对）、卵泡刺激素（D对）。孕激素（P351）（E错，为本题正确答案）无促排卵作用，主要用于调节月经周期。